中医治疗病毒性脑炎气虚血瘀证的首选方剂是
A. 补阳还五汤
B. 玉屏风散
C. 四物汤
D. 桃红四物汤
E. 八珍汤

正确答案：A。补阳还五汤

解析：病毒性脑炎的气虚血瘀证多为疾病的恢复期，因久病体弱以致气虚推动无力，血行不畅而致，所以宜用具有补气，活血，通络之功效的补阳还五汤（A对）；玉屏风散具有益气固表止汗之功效，主治表虚自汗证，症见汗出恶风，面色㿠白，舌淡苔薄白，脉浮虚。亦治虚人腠理不固，易感风邪（B错）；四物汤具有补血调血之功效，主治营血亏虚证、冲任虚损证、产后恶露不下，结生瘕聚，少腹坚痛等（C错）；桃红四物汤具有养血活血的功效，与指迷茯苓丸合用，可以治疗病毒性脑炎的痰瘀阻络证，症见神识不明，肢体不用，僵硬强直，或震颤抖动，肌肉萎软，或见面瘫、斜视，舌紫暗或有瘀点，舌苔薄白，脉弦滑（D错）；八珍汤具有益气补血之功效，主治气血两虚证，症见面色苍白或萎黄，头晕耳眩，四肢倦怠，气短懒言，心悸怔忡，饮食减少，舌淡苔薄白，脉细弱或虚大无力（E错）。